能产生房水的结构是
A. 虹膜
B. 晶状体
C. 睫状体
D. 角膜
E. 玻璃体

正确答案：C。睫状体

解析：能产生房水的结构是睫状体（C对）。